服用抗角化药维A酸时
A. 忌饮酒
B. 宜多饮水
C. 忌喝茶
D. 禁吸烟
E. 宜多食脂肪餐

正确答案：E。宜多食脂肪餐

解析：本题考查服用药物的特殊提示。维A酸脂溶性强，多食脂肪餐（E对）能够增加药物吸收，增加疗效。饮酒（A错），饮水（B错），喝茶（C错），吸烟（D错）对其无影响。